属于周期特异性的抗癌药物是
A. 甲氨蝶呤
B. 顺铂
C. 甲酰溶肉瘤素
D. 长春新碱
E. 氟尿嘧啶

正确答案：A、D、E。甲氨蝶呤；长春新碱；氟尿嘧啶

解析：本题考查周期特异性抗癌药。细胞周期特异性药物（1）S期特异性药物：如甲氨蝶呤（A对）、巯嘌呤、氟尿嘧啶（E对）、阿糖胞苷等。（2）M期特异性药物：如长春碱、长春新碱（D对）、秋水仙碱、鬼臼毒素等。（3）G₂期和M期特异性药物：如紫杉醇。顺铂（B错）和甲酰溶肉瘤素（C错）（氮甲）均为细胞周期非特异性药物。